患者，女，44岁，半年前诊断为支气管哮喘，间断口服沙丁胺醇4mg，tid治疗。没有规律用药治疗。今日，因秋冬季节交替，出现明显喘憋，话不成句，被紧急送往医院，该患者出现支气管哮喘急性发作，应首选的治疗药物是
A. 沙丁胺醇片
B. 布地奈德气雾剂
C. 沙丁胺醇气雾剂
D. 沙美特罗氟替卡松粉吸入剂
E. 异丙托溴铵雾化吸入剂

正确答案：C。沙丁胺醇气雾剂

解析：本题考查支气管哮喘用药。该患者出现支气管哮喘急性发作，应首选的治疗药物是沙丁胺醇气雾剂（C对）。短效β₂受体激动剂吸入给药，能够迅速缓解支气管痉挛，通常在数分钟内起效，疗效可维持数小时，是缓解轻至中度哮喘急性症状的首选药物，也可用于预防运动性哮喘。沙丁胺醇片（A错）口服给药，通常在服药后15～30分钟起效，疗效维持4～6小时。使用虽较方便，但心悸、骨骼肌震颤等不良反应比吸入给药时明显。布地奈德气雾剂（B错）可用于哮喘慢性持续期的治疗。沙美特罗氟替卡松粉吸入剂（D错）为长效β₂受体激动剂。异丙托溴铵雾化吸入剂（E错）为吸入性抗胆碱药物。